治疗痢疾表邪未解而里热已盛者，应首选
A. 藿香正气散
B. 人参败毒散
C. 葛根芩连汤
D. 芍药汤
E. 白头翁汤

正确答案：C。葛根芩连汤

解析：葛根芩连汤中葛根为君，既能解表退热，又能升发脾胃清阳之气而治下利；黄芩、黄连为臣，清热燥湿，厚肠止利；甘草调和诸药；四药合用，外疏内清，表里同治，使表解里和，热利自愈。故最宜治疗痢疾表邪未解而里热已盛者（C对）。藿香正气散，其功用为解表化湿，理气和中，可用于夏天感寒湿而痢者，也可用于呕吐之外邪犯胃证或泄泻之寒湿内盛证（A错）。人参败毒散，其功用为散寒祛湿，益气解表，可用于外邪陷里而成之痢疾，意即疏散表邪，表气疏通，里滞亦除，称为“逆流挽舟”法(B错)。芍药汤，其功用为调气行血，清热解毒，适用于痢疾之湿热痢（D错）。白头翁汤其功用为清热凉血解毒，与芍药汤合用可治疗疫毒痢（E错）。